用于创伤、溃疡的外用药品中不得检出
A. 破伤风杆菌
B. 绿脓杆菌
C. 活螨
D. 大肠杆菌
E. 金黄色葡萄球菌

正确答案：A、B、C、E。破伤风杆菌；绿脓杆菌；活螨；金黄色葡萄球菌